人免疫球蛋白制剂可应急预防
A. 甲型肝炎
B. 丙型肝炎
C. 麻疹
D. 脊髓灰质炎
E. 以上均是

正确答案：E。以上均是